氨氯地平的作用靶点是
A. 血管紧张素转化酶
B. β-肾上腺素受体
C. 羟甲戊二酰辅酶A还原酶
D. 钙离子通道
E. 钾离子通道

正确答案：D。钙离子通道

解析：本题考查氨氯地平的结构。氨氯地平的作用靶点是钙离子通道（D对）。氨氯地平为二氢吡啶类钙通道阻滞剂。血管紧张素转化酶（ACE）（A错）是血管紧张素转化酶抑制剂的作用靶点；肾上腺素能受体（B错）是介导儿茶酚胺作用的一类组织受体。HMG-CoA还原酶（C错）是HMG-CoA还原酶抑制剂的作用靶点；钾离子通道（E错）不是氨氯地平的作用靶点。